关于微小病变性肾小球病的病理变化正确的是
A. 肝星状细胞破坏
B. 胶质细胞增生
C. 线粒体功能障碍
D. 脂质沉积
E. 胰岛素抵抗

正确答案：D。脂质沉积

解析：微小病变性肾小球病又称微小病变性肾小球肾炎，或微小病变性肾病，病变特点是弥漫性肾小球脏层上皮细胞足突消失。光镜下肾小球基本正常，肾小管上皮细胞内有脂质沉积，故有脂性肾病之称。病理变化：肉眼观，肾脏肿胀，颜色苍白。切面肾皮质因肾小管上皮细胞内脂质沉积而出现黄白色条纹。光镜下肾小球结构基本正常，近曲小管上皮细胞内出现大量脂滴和蛋白小滴。免疫荧光检查无免疫球蛋白或补体沉积（D对）。